紫外线对DNA的损伤主要是引起
A. 碱基缺失
B. 碱基插入
C. 碱基置换
D. 嘧啶二聚体形成
E. 磷酸二酯键断裂

正确答案：D。嘧啶二聚体形成

解析：紫外线对DNA的损伤主要是引起嘧啶二聚体形成（D对），二聚体的形成可使DNA产生弯曲和扭结，影响DNA的双螺旋结构，使复制与转录受阻，其还可导致DNA链间的其他交联或链的断裂等损伤。碱基缺失（A错）是指在某个因素的作用下核苷酸脱落造成碱基缺失；碱基插入（B错）是指核苷酸在外因作用下插入某个位点；磷酸二酯键断裂（E错）意味着DNA水解为核苷酸，是DNA一级结构的破坏，以上损伤均不是由紫外线引起。